下述情况可选用的灭菌方法是：5%葡萄糖注射液
A. 干热灭菌法
B. 热压灭菌法
C. 紫外线灭菌法
D. 滤过除菌
E. 流通蒸汽灭菌法

正确答案：B。热压灭菌法